下列不属于先兆流产症状的是
A. 阴道流血
B. 腹痛
C. 腰背痛
D. 小腹坠胀
E. 阴道胎块

正确答案：E。阴道胎块

解析：阴道胎块（E错，为本题正确答案）可见于难免流产、不全流产等，为妊娠物排出症状。先兆流产指妊娠28周前先出现少量阴道流血（A对），常为暗红色或血性白带，继之出现阵发性下腹痛（B对）或腰背痛（C对）、小腹坠胀（D对）。